对某5岁男童进行的膳食调查结果，其宏量营养素的摄入量，分别是蛋白质71.5g、脂肪45g、碳水化合物172g，应对其作出的最佳膳食营养素建议是
A. 增加碳水化合物供能比至60%
B. 降低蛋白质供能比至10%～12%
C. 降低碳水化合物和脂肪的摄入量
D. 降低蛋白质摄入量，增加碳水化合物摄入量
E. 降低蛋白质和脂肪的摄入量

正确答案：D。降低蛋白质摄入量，增加碳水化合物摄入量